口腔预防医学的研究内容包括
A. 口腔卫生项目管理
B. 龋病和牙周病的预防
C. 口腔其他疾病的预防
D. 特定人群的口腔保健
E. 以上都是

正确答案：E。以上都是

解析：本题考查口腔预防医学概论。口腔预防医学的研究内容包括：口腔流行病学和口腔健康调查方法、龋病和牙周病的预防（B对）、口腔其他疾病的预防（C对）、口腔保健用品的开发及使用、特定人群的口腔保健（D对）、口腔健康促进与健康教育、口腔卫生项目管理（A对）和口腔卫生政策以及口腔保健中的感染控制等。因此选E。